某男，70岁，患有“冠心病”十年。今天上午突然心痛巨作，面色青灰，冷汗淋漓，四肢厥冷，呼吸微弱，舌淡苔白润，脉微欲绝。临床诊断最可能是
A. 心阳虚证
B. 心脉痹阻证
C. 亡阳证
D. 心气虚证
E. 心阳暴脱证

正确答案：E。心阳暴脱证

解析：阳衰亡,不能外固,故冷汗淋漓；不能温煦四肢,故见四肢厥冷；宗气外泄,不司呼吸,故见呼吸微弱;阳气外脱,脉道失充,故面色苍白；阳衰血脉失于温通,则见心痛剧烈,唇舌青紫；心神涣散,则见神志模糊,甚则昏迷；心阳衰竭,故脉微欲绝，则为心阳暴脱证（E对）。